不属于糖皮质激素的适应证是
A. 活动性肺结核
B. 系统性红斑狼疮
C. 再生障碍性贫血
D. 风湿性关节炎
E. 过敏性休克

正确答案：A。活动性肺结核

解析：本题考查糖皮质激素的适应证。活动性肺结核（A错，为本题正确答案）属于糖皮质激素的禁忌证。糖皮质激素的适应证：1.急、慢性肾上腺皮质功能减退（包括肾上腺危象）、脑垂体前叶功能减退及肾上腺次全切除术后作替代疗法。2.自身免疫性疾病（如风湿热、风湿性和类风湿性关节炎（D对）、系统性红斑狼疮（B对））、器官移植排斥反应和过敏性疾病（如荨麻疹、过敏性鼻炎、过敏性休克（E对）等）。3.感染性休克的辅助治疗。4.血液病，如再生障碍性贫血（C对）、粒细胞缺乏症等。5.其他肌肉和关节劳损，严重天庖疮、剥脱性皮炎，溃疡性结肠炎及甲状腺危象等。